男，21岁。足底被生锈钉刺伤后8天，四肢抽搐2天，发作时头颈部后仰、强直，牙关紧闭，口唇青紫，大汗淋漓。该患者最严重的并发症是
A. 骨折
B. 舌咬伤
C. 肺部感染
D. 窒息
E. 脑疝

正确答案：D。窒息

解析：患者有典型外伤史（生锈钉刺伤），经过7天的潜伏期后，出现四肢抽搐，头颈部后仰、强直，牙关紧闭，口唇青紫（提示膈肌受影响），大汗淋漓的表现，考虑诊断为破伤风（外伤史后出现牙关紧闭、颈部强直、头后仰等肌痉挛症状及大汗淋漓的交感神经症状时，首先考虑破伤风）。其主要并发症在呼吸道，如窒息、肺不张、肺部感染（C错），同时发作时可能掉下床、骨折（A错）、舌咬伤（B错）等，其中最严重的并发症为膈肌痉挛导致窒息（D对）。破伤风不会发生脑疝（E错）。